中毒性表皮坏死松解症临床表现正确的是
A. 表皮松解，尼氏征阳性，病变仅出现在皮肤
B. 口腔黏膜红肿，出现大疱，尼氏征阴性
C. 皮肤出现疱性红斑，口腔黏膜红肿，出现大疱，但无表皮松解
D. 仅在口腔黏膜出现尼氏征阳性
E. 皮肤表皮松解，尼氏征阳性，口腔黏膜红肿，亦可出现大疱，大片糜烂，易出血

正确答案：E。皮肤表皮松解，尼氏征阳性，口腔黏膜红肿，亦可出现大疱，大片糜烂，易出血

解析：本题考查重症药物过敏反应的临床表现。中毒性表皮坏死松解症临床表现正确的是皮肤表皮松解，尼氏征阳性，口腔黏膜红肿，亦可出现大疱，大片糜烂，易出血（E对）。重型药物超敏反应，又称莱氏综合症，可发生全身广泛的大疱，波及全身体窍、黏膜和内脏，称为中毒性表皮坏死松解症松解症，为急性发病，有较重的全身症状，高热、咽痛、头痛、肌肉痛、关节痛，可有呕吐腹泻症状，严重者可致昏迷。皮肤可出现全身性广泛的水疱，疱融合后形成大片损害，破溃后呈糜烂面，皮肤红肿，剧烈疼痛，除口腔皮肤外，身体其他腔孔的黏膜，如眼睛、鼻腔、阴道等均可出现大疱、糜烂、易出血。病理表现为棘层松解可出现于表皮浅层甚至颗粒层。